患者，女，46岁，已婚。经来无期，现已持续20天未止，开始量多，现淋漓不尽，色淡、质稀，腰酸腿软，溲频清冷，舌淡苔白，脉沉细，应予止血调经。其治法是
A. 温肾固冲
B. 滋水益阴
C. 补气养血
D. 健脾益气
E. 滋阴固肾

正确答案：A。温肾固冲

解析：该患者经来无期，现已持续20天未止，开始量多，现淋漓不尽，故诊断为崩漏。经来无期，持续20多天未止，量多，淋漓不尽为肾阳虚衰，阳不摄阴，封藏失司，冲任不固所致，肾阳虚衰血失温煦，故色淡、质稀，肾阳虚，气化失职，肾气不固，故腰膝酸软，溲频清冷。舌淡太白，脉沉细为阳气虚衰之象，故辨为肾阳虚证，治宜温肾益气，固冲止血，故其治法为温肾固冲（A对）。滋水益阴为阴虚的治法（B错）。补气养血为气血两虚的治法（C错）。健脾益气为脾气虚的治法（D错）。滋阴固肾为肾阴虚的治法（E错）。